患儿，6岁。1周来颜面及踝部稍有浮肿，小便短赤，舌红苔黄腻，脉滑数。其治法是
A. 疏风利水
B. 清热利湿
C. 淡渗利湿
D. 泻肺逐水
E. 清热解毒

正确答案：B。清热利湿

解析：患儿1周来颜面及踝部稍有浮肿，当属急性肾小球肾炎。急性肾炎是以浮肿、少尿、血尿、蛋白尿及高血压为主要特征，湿热郁遏肌表，内犯肺脾，致使肺失通调，脾失健运，水无所主，流溢肌肤，则见颜面及踝部有浮肿，小便短赤，舌红苔黄腻，脉滑数均为湿热之象，治以清利湿热（B对）。患者无表证之象，不需疏风，疏风利水适于风水相搏之证（A错）。淡渗利湿适于水湿内停，无清利湿热之效（C错）。泻肺逐水适于水咳逆上气，喘鸣迫塞，支饮胸满者（D错）。清热解毒主治里热炽盛证、热毒证及痈肿疔毒等（E错）。